治疗呼吸不利、咳喘等症，主要责于
A. 心与肾
B. 脾与肾
C. 肺与肾
D. 肝与肾
E. 肝与脾

正确答案：C。肺与肾

解析：本题考查的是五脏之间的关系。治疗呼吸不利、咳喘等症，主要责于主要责于肺与肾（C对）。肺与肾的关系主要表现于津液代谢、呼吸运动、阴液互滋两个方面。心与肾（A错）的关系，主要表现在心肾阴阳水火既济与心血肾精之间的依存关系。脾与肾（B错）的关系，主要表现于先天后天相辅相成和津液代谢方面。肝与肾（D错）的关系，称“肝肾同源”或“乙癸同源”（以天干配五行，肝属乙木，肾属癸水，故称），主要表现于精血同源、藏泄互用及阴阳互资等方面。肝与脾（E错）的关系，主要表现在饮食物的消化和血液生成、贮藏及运行方面。